女，59岁。背部皮肤红肿7天，痛疼、恶寒、发热1天，糖尿病10年。查体：T39℃，P100/分，背面红肿皮肤有多个脓点，范围6cm×5cm，Hb120g/L，WBC18.6×10⁹/L，Plt200×10⁹/L.切开引流方法不正确的是
A. 每日换敷料一次
B. 清除脓点
C. 引流时作做“+"切口
D. 切口边缘在病灶范围之内
E. 切口深度须达到痈的基底部

正确答案：D。切口边缘在病灶范围之内

解析：中年女性患者，背部皮肤红肿7天，痛疼、恶寒、发热1天（痈的表现），糖尿病10年.查体：T39℃，P100/分，背面红肿皮肤有多个脓点（提示痈），范围6cm×5cm，故患者考虑为痈，痈的切口线应达到病变边沿健康组织（D错，为本题正确答案）。术后患者应当每日换敷料一次（A对）。痈患者引流时一般以清除脓点为主（B对），作“+”切口（C对），切口深度须达到痈的基底部（E对）。